切除子宫做病理检查，光镜下见子宫壁深肌层内有大量异型的滋养层细胞浸润，并有绒毛结构，应诊断为
A. 水泡状胎块
B. 子宫内膜癌
C. 侵蚀性葡萄胎
D. 绒毛膜癌
E. 子宫颈癌

正确答案：C。侵蚀性葡萄胎

解析：子宫病理检查，光镜下见子宫壁深肌层内有大量异型的滋养层细胞浸润，并有绒毛结构，应诊断为侵蚀性葡萄胎（C对）。水泡状胎块（A错）又称良性葡萄胎，其虽然也可见滋养层细胞浸润和绒毛结构，但绒毛不会侵入子宫壁深肌层。绒毛膜癌（D错）不见绒毛和水泡状结构。子宫内膜癌（B错）和子宫颈癌（E错）均不属于滋养层细胞肿瘤，不会出现异型的滋养细胞浸润。